体内肌肉能量的储存形式是
A. CTP
B. ATP
C. 磷酸肌酸
D. 磷酸烯醇或丙酮酸
E. 所有的三磷酸核苷酸

正确答案：C。磷酸肌酸

解析：ATP将其高能磷酸键转移给肌酸生成磷酸肌酸，当体内ATP不足时，磷酸肌酸可将其高能磷酸键转移给ADP生成ATP，再为生理活动提供能量。掌握“ATP”知识点。